能产生白细胞毒素的牙周细菌是
A. 嗜二氧化碳噬纤维菌
B. 牙龈卟啉单孢菌
C. 核梭杆菌
D. 伴放线放线杆菌
E. 螺旋体

正确答案：D。伴放线放线杆菌

解析：本题考查重要的牙周致病菌-伴放线聚集杆菌。能产生白细胞毒素的牙周细菌是伴放线放线杆菌（D对）。伴放线聚集杆菌因常与放线菌共生，故命名为伴放线放线杆菌，后又根据DNA同源性研究和rRNA序列分析，又将该菌归属于全新的聚集杆菌属，被命名为伴放线聚集杆菌，它们实质上是异名同菌，只是归属不同。伴放线聚集杆菌（伴放线放线杆菌）是唯一能分泌白细胞毒素的细菌，白细胞毒素可损伤人牙龈内和外周血中的中性粒细胞、单核细胞和淋巴细胞的细胞膜，导致白细胞死亡，释放溶酶体，造成牙周组织的破坏。嗜二氧化碳噬纤维菌（A错）可产生多种蛋白酶，不能分泌白细胞毒素。牙龈卟啉单孢菌（B错）可分泌大量的毒力因子，产生多种胞外蛋白酶（牙龈素、胶原酶）、内毒素、碱性磷酸酶、吲哚、有机酸等代谢产物，不能产生白细胞毒素。核梭杆菌（C错）可产生内毒素、蛋白酶、硫酸酯酶以及一些有机酸等，但不能产生白细胞毒素。螺旋体（E错）可产生内毒素样物质，以及大量的硫化氢和氨，无白细胞毒素产生。